呈现圆脸厚背躯干发胖而四肢消瘦的“向心性肥胖”的特殊体形，提示
A. 甲状腺激素分泌过多
B. 生长素分泌过多
C. 肾上腺糖皮质激素分泌过多
D. 肾上腺素分泌过多
E. 胰岛素分泌不足

正确答案：C。肾上腺糖皮质激素分泌过多

解析：GC（糖皮质激素）对脂肪组织的主要作用是提高四肢部分的脂肪酶活性，促进脂肪分解，使血浆中脂肪酸浓度增加，并向肝脏转移，增强脂肪酸在肝内的氧化，以利于糖异生。由于机体不同部位对GC的敏感性不同，所以在肾上腺皮质功能亢进或大剂量应用GC类药物（C对）时，机体内脂肪重新分布，主要沉积于面、颈、躯干和腹部，而四肢分布减少，形成“满月脸”、“水牛背”、四肢消瘦的“向心性肥胖”体征。甲状腺激素分泌过多可产生甲亢（A错）。生长激素在幼儿时分泌过多可产生巨人症，成人分泌过多产生肢端肥大症（B错）。肾上腺素分泌过多见于嗜铬细胞瘤（D错）。胰岛素分泌不足见于糖尿病（E错）。